哺乳期妇女禁用的药有
A. 甲氨喋呤
B. 甲巯咪唑
C. 甲状腺素
D. 甲丙氨酯
E. 溴隐停

正确答案：A、B、C、D、E。甲氨喋呤；甲巯咪唑；甲状腺素；甲丙氨酯；溴隐停